发现有人晕倒时，确认所处环境安全后应立即采取的措施是
A. 进行胸外按压
B. 行人工呼吸
C. 报警
D. 大声呼叫救援
E. 判断意识是否清楚

正确答案：E。判断意识是否清楚

解析：发现有人晕倒时，确认所处环境安全后应立即采取的措施是尽早识别心搏骤停，判断意识是否清楚（E对）。确立心脏骤停诊断后，应立即开始初级心肺复苏（AB错）。在不延缓实施心肺复苏的同时，应设法（打电话或呼叫他人打电话）（CD错）通知并启动急救医疗系统（九版内科学P317）。